小儿脊柱出现胸椎后突的时间是
A. 出生后3个月
B. 出生后6个月
C. 出生后9个月
D. 出生后10个月
E. 1岁

正确答案：B。出生后6个月

解析：小儿运动发育可概括为“三抬四翻六会坐，七滚八爬岁会走”，其中抬头动作出现使颈椎前凸（A错）；坐的动作使脊柱出现胸椎后凸（B对）；行走使脊柱出现腰椎前凸（E错）。